（牙合）面的边缘嵴和发育沟使整个牙面似一“田”字形的是
A. 上颌第一磨牙
B. 上颌第二磨牙
C. 下颌第一磨牙
D. 下颌第二磨牙
E. 下颌第三磨牙

正确答案：D。下颌第二磨牙

解析：本题考查磨牙的牙合面形态特点。下颌第二磨牙（D对）牙合面的边缘嵴和发育沟使整个牙合面似一“田”字形。上颌第一磨牙牙合面呈斜方形，主要解剖特征为近中舌尖三角嵴与远中颊尖三角嵴斜形相连形成的斜嵴（A错）。上颌第二磨牙与上颌第一磨牙形态相似（B错），体积稍小。下颌第一磨牙牙合面形态复杂，为牙合面尖、嵴、窝、沟、斜面最多的牙，轮廓似长方形（C错）。下颌第三磨牙常有变异，牙合面尖、嵴、窝、沟不清晰，副沟多（E错）。